医学伦理学的公正原则，是指
A. 不同病人给予不同对待
B. 不同的经济给予不同对待
C. 不同样的需要给予同样的对待
D. 同样需要的人给予同样的对待
E. 不同的病情给予同样的对待

正确答案：D。同样需要的人给予同样的对待